我国发生的严重急性呼吸综合征（SARS），很快波及许多省市，这种发病情况称为
A. 暴发
B. 季节性升高
C. 流行
D. 周期性流行
E. 长期变异

正确答案：C。流行